根据《中华人民共和国刑法》甲报社对假药进行虚假宣传，构成
A. 生产、销售假药罪
B. 生产、销售劣药罪
C. 生产、销售伪劣商品罪
D. 虚假广告罪
E. 非法经营罪

正确答案：D。虚假广告罪

解析：本题考查药品安全法律责任。根据《中华人民共和国刑法》甲报社对假药进行虚假宣传，构成虚假广告罪（D对）。